不宜口服给药的药物是
A. 硝酸甘油
B. 硝苯地平
C. 普萘洛尔
D. 胍乙啶
E. 洛伐他汀

正确答案：A。硝酸甘油

解析：本题考查硝酸甘油。硝酸甘油（A对）口服被胃肠道吸收后无效，舌下含服能通过口腔黏膜，血药浓度很快达峰，迅速起效。硝苯地平（B错）、普萘洛尔（C错）、胍乙啶（D错）、洛伐他汀（E错）均通过口服给药。